脾的长轴与第几肋一致
A. 第7肋
B. 第8肋
C. 第9肋
D. 第10肋
E. 第11肋

正确答案：D。第10肋

解析：脾位于9~11肋深面，长轴于第10肋一致（D对）。